甲肝的重要传染源是
A. 急性黄疸型患者
B. 慢性患者
C. 慢性携带者
D. 重型肝炎患者
E. 亚临床感染者

正确答案：A。急性黄疸型患者

解析：本题考查甲肝的传染源。甲肝的传染源包括急性期病人、亚临床型感染者、感染的动物。其中急性期病人中的急性黄疸型患者（A对BCDE错）是甲肝的重要传染源。